在下列寡肽和多肽中，除哪种外均是生物活性肽
A. 催产素
B. 加压素
C. 促肾上腺皮质激素
D. 促甲状腺素释放激素
E. 胰高血糖素

正确答案：E。胰高血糖素